锁骨下动脉是以下哪个部位的动脉主干
A. 颅顶
B. 颈前部
C. 硬脑膜
D. 口腔颌面部
E. 颈部下份深面结构

正确答案：E。颈部下份深面结构

解析：颈外动脉是颈前部、口腔颌面部、颅顶及硬脑膜等处的动脉主干。锁骨下动脉是供应颈部下份深面结构及脑的后2/5部分的动脉主干。掌握“颈内外动脉主要分支及分布”知识点。